催化三羧酸循环第一步反应的酶是
A. 异柠檬酸脱氢酶、α酮戊二酸脱氢酶
B. 柠檬酸合成酶、琥珀酸脱氢酶
C. 柠檬酸合成酶
D. 琥珀酸合成酶
E. 苹果酸脱氢酶

正确答案：C。柠檬酸合成酶